HACCP体系的基本原理和组成部分不包括
A. 危害分析
B. 确定关键控制点
C. 确定监控措施
D. 人员培训
E. 建立纠偏措施

正确答案：D。人员培训

解析：本题考查HACCP体系的基本原理和组成部分。HACCP即危害分析关键控制点，是一种食品安全保证体系，其基本含义是，为保障食品安全，对食品生产加工过程中造成食品污染发生或发展的各种危害因素进行系统和全面的分析，确定能有效预防、减轻或消除危害的加工环节（即“关键控制点”），进而在关键控制点对危害因素进行控制，同时监测控制效果，发生偏差时予以纠正，并随时对控制方法进行矫正和补充。HACCP体系一般由七个基本原理和部分组成：①危害分析（A对）；②确定关键控制点（B对）；③确定关键限值；④确定监控措施（C对）；⑤建立纠偏措施（E对）；⑥建立审核（验证）措施；⑦建立记录保存措施。人员培训（D错，为本题正确答案）不属于HACCP体系的基本原理和组成部分。